胆囊炎的下列哪个证型常用茵陈蒿汤合大柴胡汤治疗
A. 肝胆气郁证
B. 肝胆湿热证
C. 热毒内蕴证
D. 血瘀痰凝证
E. 肝胃不和证

正确答案：B。肝胆湿热证

解析：茵陈蒿汤合大柴胡汤的功效是清胆利湿，通气通腑，适用于胆囊炎湿热证（肝胆湿热）（B对）。胆囊炎中医可辨为蕴热证（肝胆蕴热）、湿热证（肝胆湿热）、热毒证（肝胆脓毒）。金铃子散合大柴胡汤可用于蕴热证（肝胆蕴热）。黄连解毒汤和茵陈蒿汤可用于热毒证（肝胆脓毒）（C错）。